患者经行量多，色淡红，四肢倦怠，气短懒言，舌淡，脉细数，其证候是
A. 阳盛血热证
B. 气虚证
C. 血虚证
D. 气滞血瘀证
E. 肾虚证

正确答案：B。气虚证

解析：患者经行量多，色淡红，四肢倦怠，气短懒言，舌淡，脉细数，可诊断为月经过多气虚证。气虚则冲任不固，经血失于制约，故经行量多；气虚火衰不能化血为赤，故经色淡红，质稀；气虚中阳不振，故神疲肢倦，气短懒言，气虚失于升提，故小腹空坠，面色晄白，舌淡，脉细弱均为气虚之征（B对）。月经过多血热证表现为经行量多，色鲜红或深红，质黏稠，伴口渴心烦，尿黄便结，舌红苔黄脉滑数（A错）。月经过多血瘀证的表现为经行量多，色紫黯有血块，经行腹痛，舌质暗或有瘀点，脉涩（D错）。血虚（C错）、肾虚（E错）会导致月经过少。